问题的形式不正确的是
A. 填空式
B. 二项式
C. 顺位式问句
D. 半封闭式
E. 矩阵式

正确答案：D。半封闭式

解析：本题考查问题的形式。问题的形式不正确的是半封闭式（D错，为本题的正确答案）。1.问题的结构：（1）开放型问题；（2）封闭型问题；（3）半封闭型问题。2.问题的形式：（1）填空式（A对）；（2）二项式（B对）；（3）列举式；（4）多项选择式；（5）顺位式问句（C对）；（6）多项任选式；（7）评分式问句；（8）矩阵式（E对）。